具有破血消癥、攻毒蚀疮、引赤发疱等功能的生药是
A. 麝香
B. 牛黄
C. 斑蝥
D. 蟾酥
E. 鹿茸

正确答案：C。斑蝥

解析：本题考查的是斑蝥的功效。具有破血消癥、攻毒蚀疮、引赤发疱等功能的生药是斑蝥（C对）。斑蝥：【功效】攻毒蚀疮，破血逐瘀，散结消癥。麝香（A错）：【功效】开窍醒神，活血通经，消肿止痛。牛黄（B错）：【功效】清热解毒，息风止痉，化痰开窍。蟾酥（D错）：【功效】解毒消肿，止痛，开窍醒神。鹿茸（E错）：【功效】壮肾阳，益精血，强筋骨，调冲任，托疮毒。